决定职业有害因素接触剂量的主要条件是
A. 接触机会和接触强度
B. 接触时间和接触机会
C. 接触方式和接触强度
D. 接触时间和接触强度
E. 接触时间和接触方式

正确答案：D。接触时间和接触强度